用于人体预防接种的疫苗分为几类
A. 2类
B. 3类
C. 4类
D. 5类
E. 1类

正确答案：A。2类